下列哪项不是深Ⅱ度烧伤的特点
A. 创面可有或无水疱
B. 创面痛觉迟钝
C. 有时可见树枝状栓塞血管
D. 如无感染，3～4周可愈合
E. 愈合后多留有增生性瘢痕

正确答案：C。有时可见树枝状栓塞血管

解析：本题考查火器伤、热烧伤。有时可见树枝状栓塞血管（C错，为本题正确答案）不是深Ⅱ度烧伤的特点。深Ⅱ°烧伤：伤及皮肤的真皮层，介于浅Ⅱ°和Ⅲ°之间，深浅不尽一致，也可有水疱（A对），但去疱皮后，创面微湿，红白相间，痛觉较迟钝（B对）。由于真皮层内有残存的皮肤附件，可赖其上皮增殖形成上皮小岛，如不感染，可融合修复，需时3～4周（D对）。但常有瘢痕增生（E对）。